利血平+氢氯噻嗪
A. 产生有利的药物相互作用
B. 抑制乙醛脱羧酶
C. 造成听神经和肾功能不可逆损害
D. 抑制氧化代谢反应
E. 诱发硬膜下血肿

正确答案：A。产生有利的药物相互作用

解析：本题考查联合用药。利血平+氢氧噻嗪产生有利的药物相互作用（A对）。利尿药（如氢氯噻嗪）与降压药（如利血平）合用能使降压作用加强。